某社区检测了10000人的血清HBsAg，1000人阳性，该调查合适的描述指标为
A. 发病率
B. 患病率
C. 罹患率
D. 感染率
E. 生存率

正确答案：D。感染率

解析：本题考查感染率。感染率（D对ABCE错）是指在某时间内被检人群中某病原体现有感染者人数所占的比例。感染率在流行病学工作中应用较广泛，特别是对那些隐性感染、病原携带者及轻型和不典型病例的调查较为常用。